主治医师王某被注销职业注册满1年，现想重新执业，遂向卫生行政部门递交了相关申请，但未获得批准，其原因是
A. 在医疗机构的试用期不满1年
B. 刑事处罚完毕后不足2年
C. 未到基层医疗机构锻炼
D. 变更执业地点不满2年
E. E未经过医师规范化培训.

正确答案：B。刑事处罚完毕后不足2年

解析：注册执业医师时，有下列情形之一的，不予注册：①不具有完全民事行为能力的；②因受刑事处罚，自刑罚执行完毕之日起至申请注册之日止不满2年的；③受吊销医师执业证书行政处罚，自处罚决定之日起至申请注册之日止不满2年的（B对）；④有国务院卫生行政部门规定不宜从事医疗、预防、保健业务的其他情形的。